月经来潮的原因是
A. 血中雌激素和孕激素水平都升高
B. 血中雌激素水平降低，孕激素水平升高
C. 血中雌激素水平降低，孕激素水平不变
D. 血中雌激素水平降低，孕激素水平降低
E. 血中雌激素水平升高，孕激素水平降低

正确答案：D。血中雌激素水平降低，孕激素水平降低

解析：黄体退化后，血中雌激素水平和孕激素水平都降低（D对），子宫内膜缺乏性激素的支持，发生剥离、出血、脱落，即月经来潮。